在农村介水传染病流行时，应监测的指标为
A. 水温、pH、色度、浑浊度、总大肠菌群和余氯
B. 水温、pH、色度、浑浊度、细菌总数和余氯
C. 水温、pH、色度、余氯、细菌总数和总大肠菌群
D. pH、色度、浑浊度、余氯、细菌总数和粪大肠菌群
E. pH、水温、色度余氯细菌总数和粪大肠菌群

正确答案：A。水温、pH、色度、浑浊度、总大肠菌群和余氯

解析：本题考查介水传染病流行时应监测的指标。介水传染病指通过饮用或接触受病原体污染的水而传播的疾病，又称水性传染病。在农村介水传染病流行时，应监测的指标为水温、pH、色度、浑浊度、总大肠菌群和余氯（A对BCDE错）。